断面白色或灰白色，粉性，形成层环纹棕色、近方形或近圆形，皮部散有多数棕色油点的药材是
A. 石菖蒲
B. 白芷
C. 天花粉
D. 黄芩
E. 商陆

正确答案：B。白芷

解析：本题考查的是白芷的性状鉴别。断面白色或灰白色，粉性，形成层环纹棕色、近方形或近圆形，皮部散有多数棕色油点的药材是白芷（B对）。白芷【性状鉴别】饮片为类圆形的厚片。外表皮灰棕色或黄棕色。切面白色或灰白色，显粉性，形成层环棕色，近方形或近圆形，皮部散有多数棕色油点。石菖蒲（A错）【性状鉴别】饮片呈扁圆形或长条形厚片。外表皮棕褐色或灰棕色，有的可见环节及根痕，切面纤维性，类白色或微红色，有明显环纹及油点。天花粉（C错）【性状鉴别】饮片为类圆形、半圆形或不规则形厚片。外表皮黄白色或淡棕黄色。切面可见黄色木质部小孔，略呈放射状排列。黄芩（D错）【性状鉴别】饮片黄芩片：为类圆形或不规则形薄片，外表皮黄棕色至棕褐色，切面黄棕色或黄绿色，具有放射状纹理。商陆（E错）【性状鉴别】药材为横切或纵切的不规则块片，厚薄不等。外皮灰黄色或灰棕色。横切片弯曲不平，边缘皱缩，直径2～8cm；切面浅黄棕色或黄白色，异型维管束隆起，其木部明显，形成数个突起的同心性环轮，习称“罗盘纹”。纵切片弯曲或卷曲，长5～8cm，宽1～2cm，异型维管束木部呈平行条状突起。饮片生商陆：为厚片或块，余同药材。